维生素A过量可引起
A. 钙在骨质沉积增加
B. 成骨细胞活性增强
C. 凝血时间缩短
D. 脱皮、脱发
E. 食欲增高

正确答案：D。脱皮、脱发